当某一感官处于功能状态时，另一感官出现幻觉，此现象是
A. 功能性幻觉
B. 内脏性幻觉
C. 假性幻觉
D. 反射性幻觉
E. 原始性幻觉

正确答案：D。反射性幻觉

解析：当某一感觉器官处于功能活动状态时，出现涉及另一感官的幻觉是反射性幻觉（D对）。功能性幻觉是一种伴随现实刺激而出现的幻觉，即当某种感觉器官处于功能活动状态时出现涉及该器官（A错）的幻觉，正常知觉与幻觉并存。内脏幻觉是患者身体内部某一部位或某一脏器（B错）虚幻的知觉体验。假性幻觉是存在于自己的主观空间内，不通过感觉器官（C错）而获得的幻觉。